金钱草具有的功效是
A. 清肺润燥
B. 清肺化痰
C. 泄热通便
D. 解毒消肿
E. 清热解暑

正确答案：D。解毒消肿

解析：该题考查金钱草的功效，属记忆内容。金钱草味甘、咸，性微寒；入肝、胆、肾、膀胱经；具有利湿退黄，利尿通淋，解毒消肿的功效（D对ABCE错）。